对甲状腺肿瘤性质诊断正确率可达80%以上的检查方法是
A. B超
B. CT
C. ECT
D. 磁共振
E. 细针穿刺细胞学

正确答案：E。细针穿刺细胞学

解析：细针穿刺细胞学（E对）检查已广泛应用于诊断甲状腺结节的性质，其正确率可达80%以上（5版外科学P344）。B超（A错）是甲状腺结节的首选影像学检查方法，能够显示结节的数目、位置、毗邻，还能提供结节的供血情况；CT（B错）能显示病灶数目、部位、与邻近结构关系以及有无淋巴结肿大；ECT（C错）能够反映甲状腺局部及整体功能；磁共振（D错）可评价病变范围及与周围重要结构的关系，以上四种检查均能粗略甄别结节性质，但正确率不到80%。